下列关于辐射灭菌的叙述中，正确的是
A. 通过损伤微生物的核酸及酶类的物理灭菌方法
B. 具有穿透力强、灭菌可靠和不使物品升温的优点
C. 可应用于一次性塑料、乳胶医用品等不耐热医用品
D. 可用于精密仪器、移植的组织等的灭菌处理
E. 以上均正确

正确答案：E。以上均正确

解析：辐射灭菌是利用专用设施放射源钴60（60Co）产生的γ射线或电子加速器产生的β射线，通过损伤微生物的核酸及酶类的物理灭菌方法，具有穿透力强、灭菌可靠和不使物品升温等优点。它日益被广泛应用于一次性塑料、乳胶医用品，生物制品及药品等不耐热医用品，精密仪器、移植的组织、人工器官和节育用品等的灭菌处理。掌握“消毒与灭菌”知识点。